药品成分的含量与国家药品标准或者省、自治区、直辖市药品标准规定不符合的是
A. 劣药
B. 假药
C. 保健药品
D. 非处方药
E. 特殊药品

正确答案：A。劣药

解析：药品成分的含量与国家药品标准或者省、自治区、直辖市药品标准规定不符合的是劣药（A对）。假药是指药品所含成分与国家药品标准规定的成分不符，以及以非药品冒充药品或者以他种药品冒充此种药品的（B错）。保健药品即以调节人体机能为主要目的的保健品（C错）。非处方药是指为方便公众用药，在保证用药安全的前提下，经国家卫生行政部门规定或审定后，不需要医师或其它医疗专业人员开写处方即可购买的药品（D错）。特殊药品是指国家制定法律制度，实行比其他药品更加严格的管制的药品（E错）。